不经腹膜腔即可施行手术的器官
A. 胃
B. 横结肠
C. 脾
D. 膀胱
E. 空、回肠

正确答案：D。膀胱

解析：不经腹膜腔即可施行手术的器官为膀胱(D对)，因为膀胱为腹膜间位器官，有裸露于腹膜外的部分，而胃(A错)、横结肠(B错)、脾(C错)、空回肠(E错)均为腹膜内位器官，几乎全被腹膜覆盖，手术时需要经过腹膜腔。